心包填塞时不出现
A. 心音低钝
B. 声音嘶哑
C. 奇脉
D. 肝颈静脉反流征阳性
E. 双肺满布干湿啰音

正确答案：E。双肺满布干湿啰音

解析：双肺满布干湿啰音（E错，为本题正确答案）提示肺部淤血严重，常见于急性左心衰竭患者。心包填塞时，由于心包出现大量积液，此时心音听诊会受到影响，表现为心音低钝（A对）而遥远；若积液过多而压迫气管、食管而产生干咳、声音嘶哑（B对）及吞咽困难；若积液量过多而影响静脉回流，可出现肝颈静脉反流征阳性（D对）；心脏填塞的患者，吸气时一方面右心室舒张功能受限，回心血量减少影响右心排血量；另一方面受吸气时胸腔负压的影响，肺血管扩张，回流左心的血液量减少，左室排血也减少，这些因素形成吸气时脉搏减弱，甚至不能触及，即为奇脉（C对）。